（牙合）片不包括
A. 上颌前部（牙合）片
B. 上颌后部（牙合）片
C. 下颌前部（牙合）片
D. 下颌后部（牙合）片
E. 下颌横断（牙合）片

正确答案：D。下颌后部（牙合）片

解析：本题考查牙合片。牙合片不包括下颌后部牙合片（D错，为本题正确答案）。牙合片：①下颌前部牙合片（C对）；②上颌后部牙合片（B对）；③上颌前部牙合片（A对）；④下颌横断牙合片（E对）。